GSP规定的质量管理制度的重点在于经营活动的下列环节
A. 进货
B. 入库验收
C. 在库养护
D. 售后服务
E. 出库复核

正确答案：A、B、C、D、E。进货；入库验收；在库养护；售后服务；出库复核

解析：本题考查质量管理制度。GSP规定的质量管理制度包括药品批发的质量管理和药品零售的质量管理等。其中药品批发的质量管理分为14节，共118条；药品零售的质量管理分为8节，共59条。重点在于经营活动的进货（A对）、入库验收（B对）、在库养护（C对）、售后服务（D对）及出库复核（E对）。